恒牙龋病的最好发牙位为
A. 下颌第一、二磨牙
B. 上颌第一、二磨牙
C. 前磨牙
D. 上前牙
E. 以上牙位依次好发

正确答案：A。下颌第一、二磨牙

解析：本题考查恒牙龋病的好发牙位。龋病的发病频率与牙位有关，在恒牙列，最好发牙位为下颌第一、二磨牙（A对），此后依次是上颌第一磨牙、上颌第二磨牙（B错）、前磨牙（C错）、第三磨牙、上颌前牙（D错）、下颌前牙。以上牙位龋病发病率依次降低（E错）。